工人王某，是东北某地炼铁厂炉前工，上班时定期开炉观察冶炼状态并采集分析，工龄25年，一年来感到视物模糊，逐渐加重，前来就医。所患疾病最可能是
A. 视网膜退化
B. 视网膜灼伤
C. 电光性眼炎
D. 白内障
E. 老年性视力减退

正确答案：D。白内障